冠心病最常见的原因是
A. 高血压
B. 冠状动脉粥样硬化性狭窄
C. 脂代谢紊乱
D. 糖尿病
E. 肥胖

正确答案：B。冠状动脉粥样硬化性狭窄

解析：冠心病最常见的原因是冠状动脉粥样硬化性狭窄，与其有关的主要危险因素有年龄、性别、遗传背景、高血压、脂代谢紊乱、糖尿病、吸烟、肥胖、家族史等。掌握“冠状动脉粥样硬化性心脏病”知识点。